评价药物临床地位的方法是
A. 成本效益分析
B. 成本效用分析
C. 用药频度分析
D. 药物利用指数分析
E. 流行病学分析

正确答案：C。用药频度分析

解析：本题考查用药频度分析。用药频度分析（C对）是近年来用于评价药物在临床上的地位的一种新方法。